湖水如呈现绿色或黄绿色时表明
A. 水中藻类大量生长
B. 含铁的水排入湖内
C. 含硫酸盐的污水排入湖内
D. 含氯化钠的污水排入湖内
E. 含硫酸锰的污水排入湖内

正确答案：A。水中藻类大量生长

解析：本题考查湖水呈现绿色或黄绿色时表明的现象。湖水呈现绿色或黄绿色是由于水中占优势的浮游生物的颜色不同而形成的，表明水中藻类大量生长（A对BCDE错）。